在牙周膜中能够起到对抗侧向力，将牙向牙槽窝内牵引，保持牙齿直立作用的主纤维束的是
A. 根间组
B. 根尖组
C. 斜行组
D. 水平组
E. 牙槽嵴组

正确答案：E。牙槽嵴组

解析：本题考查牙周膜纤维。在牙周膜中能够起到对抗侧向力，将牙向牙槽窝内牵引，保持牙齿直立作用的主纤维束的是牙槽嵴组纤维（E对）。牙槽嵴组纤维主要分布在牙齿的唇（颊）、舌（腭）侧，邻面无此纤维。其功能是将牙齿向牙槽窝内牵引，对抗侧向力，保持牙直立。斜行组（C错）是牙周膜中数量最多、力量最强的一组纤维。可将牙承受的咀嚼压力转变为牵引力，均匀地分散到牙槽骨上。